具有吞噬和抗原提呈作用的是
A. MΦ
B. T细胞
C. B细胞
D. NK细胞
E. 嗜碱性粒细胞

正确答案：A。MΦ